下列各项中，不属于普济消毒饮组成药物的是
A. 黄芩黄连连翘
B. 玄参柴胡牛蒡子
C. 甘草桔梗马勃
D. 防风赤芍当归
E. 升麻陈皮板蓝根

正确答案：D。防风赤芍当归

解析：本题考查方剂的组成。普济消毒饮组成有黄芩、黄连、陈皮、甘草、玄参、柴胡、桔梗、连翘、板蓝根、马勃、牛蒡子、薄荷、僵蚕、升麻，药物组成中没有防风、赤芍、当归（D对）。